临床上行骨移植术的主要指征是
A. 额骨缺损
B. 颧骨缺损
C. 上颌骨缺损
D. 下颌骨缺损
E. 鼻骨缺损

正确答案：D。下颌骨缺损

解析：本题考查骨移植。下颌骨缺损（D对）常是临床上行骨移植术的主要指征。颧骨、鼻骨、额骨甚至颅骨缺损时，也可借助骨移植术以恢复外形。